周期性抑制DNA合成
A. 骨髓移植
B. Ara‐C
C. 白细胞单采
D. 羟基脲
E. 干扰素

正确答案：D。羟基脲

解析：羟基脲可周期特异性抑制DNA合成（D对）。骨髓移植为造血干细胞移植，不会抑制DNA合成（A错）。Ara-c又叫阿糖胞苷可引起细胞周期停滞和抑制DNA聚合酶，为治疗急性白血病和慢性白血病的药物（B错）。白细胞单采是用来治疗高白细胞白血病，由于外周白细胞数过多，故用机器将血液中过高的白细胞采集出来，再将剩下的血液成分送回体内，不会抑制DNA的合成（C错）。干扰素是通过直接抑制DNA多聚酶活性和干扰素调节因子的基因表达，从而影响自杀因子介导的凋亡，是治疗慢性髓细胞白血病的重要药物（E错）。